腋淋巴结分为
A. 2群
B. 3群
C. 4群
D. 5群
E. 6群

正确答案：D。5群

解析：腋淋巴结按位置分为5群（D对），分别为胸肌淋巴结、外侧淋巴结、肩胛下淋巴结、中央淋巴结、尖淋巴结。